外科红灵丹主要适用于
A. 脓肿初起
B. 溃疡阴证
C. 一切阳证未溃者
D. 一切阴证
E. 溃后生肌

正确答案：C。一切阳证未溃者

解析：红灵丹由雄黄、乳香、没药、朱砂等9味药组成，功能活血止痛，消肿化痰，适用于一切痈疽未溃属阳者（C对）。阴证（BD错）及溃疡已溃者（AE错）都为红灵丹的禁用证或慎用证。